骨折病人长期卧床可发生
A. 脂肪栓塞
B. 创伤性关节炎
C. 损伤性骨化
D. 缺血性骨坏死
E. 坠积性肺炎

正确答案：E。坠积性肺炎

解析：骨折病人长期卧床容易发生三种晚期并发症：坠积性肺炎（E对）、压疮和下肢深静脉血栓形成。特别是老年、体弱和伴有慢性病的病人，咳嗽反射减弱，呼吸道引流不畅，分泌物在肺内沉积，更容易引起坠积性肺炎。脂肪栓塞（A错）为骨折的早期并发症。创伤性关节炎（B错）多见于关节内骨折的病人，因关节面破坏未能准确复位，骨愈合后使关节面不平整，长期磨损引起。损伤性骨化（C错）是由于关节扭伤、脱位或关节附近骨折形成血肿，血肿机化并在关节附近软组织内广泛骨化，造成严重关节活动障碍，特别多见于肘关节。缺血性骨坏死（D错）多由于骨折端血液供应被破坏，致使该骨折端缺血性坏死，常见于腕舟状骨骨折、股骨颈头下型骨折的病人。